龈下刮治时，刮治器工作刃与根面形成的最佳角度是
A. 0°
B. 15°
C. 45°
D. 50°
E. 80°

正确答案：E。80°

解析：本题考查龈下刮治术。龈下刮治时，刮治器工作刃与根面形成的最佳角度是80°（E对）。刮治器械放入牙周袋时工作端的平面与牙根平面平行（A错）；达到袋底后，与根面间形成45°探查根面牙石（C错）；探到牙石根方后与牙面形成约80°角进行刮治。